注意力缺陷多动障碍患儿，症见记忆力欠佳，自控能力差，多动不安，注意力不集中，遗尿，梦多，舌苔薄，脉细，疗首选方剂是
A. 杞菊地黄丸
B. 归脾汤
C. 孔圣枕中丹
D. 甘麦大枣汤
E. 六味地黄丸

正确答案：A。杞菊地黄丸

解析：该题考查对多动症症状的了解以及方药的记忆。注意力缺陷多动障碍患儿，症见记忆力欠佳，自控能力差，多动不安，注意力不集中，遗尿，梦多，舌苔薄，脉细，判断为多动症肝肾阴虚 治法滋养肝肾，平肝潜阳。方药杞菊地黄丸加减（A对）。归脾汤治疗心脾两虚：证候 神思涣散，注意力不能集中，神疲乏力，形体消瘦或虚胖，多动而不暴躁，言语冒失，做事有头无尾，睡眠不实，记忆力差，伴自汗盗汗，偏食纳少，面色无华，舌质淡，苔薄白，脉虚弱。治法养心安神，健脾益气。方药归脾汤合甘麦大枣汤加减（B错）。孔圣枕中丹补心肾，治读书善忘，久服令人聪明（C错）。甘麦大枣汤养心安神，和中缓急之功效。主治脏躁。症见精神恍惚，常悲伤欲哭，不能自主，心中烦乱，睡眠不安，甚则言行失常，呵欠频作，舌淡红苔少，脉细微数（D错）。六味地黄丸滋阴补肾之功效。用于肾阴亏损，头晕耳鸣，腰膝酸软，骨蒸潮热，盗汗遗精，消渴（E错）。